颊神经分布的区域并接近颊神经干的位置是
A. 翼下颌韧带中点处
B. 翼下颌韧带中点外侧0.2～0.3mm处
C. 翼下颌韧带中点外侧0.5mm处
D. 翼下颌韧带中点外侧2～3mm处
E. 翼下颌韧带中点外侧5mm处

正确答案：D。翼下颌韧带中点外侧2～3mm处

解析：由于行下牙槽神经麻醉的针刺点在翼下颌韧带中点外侧2～3mm处，此进针点周围正是颊神经分布的区域并接近颊神经干，所以可在下牙槽神经阻滞麻醉过程中，针尖退至肌层、黏膜下时注射麻醉药0.5～1ml，即能麻醉颊神经。掌握“颌面部常用局麻法及牙拔除的麻醉选择”知识点。